患者，男，50岁。急性心肌梗死第2天，少尿，血压80/50mmHg，烦躁不安，面色苍白，表情淡漠，皮肤湿冷，大汗淋漓，脉细弱无力。应首先考虑的是
A. 左心衰竭
B. 急性肾衰竭
C. 心肌梗死后综合征
D. 低血糖反应
E. 心源性休克

正确答案：E。心源性休克

解析：患者因心梗引起泵衰竭，导致有效循环血量不足，出现烦躁不安、面色苍白、皮肤湿冷、大汗淋漓、脉细而快、少尿、精神迟钝或昏迷者，因此应首先考虑心源性休克（E对）。左心衰竭（A错）可表现为呼吸困难、咳嗽、发绀、烦躁等症状，严重者可出现肺水肿，随后可出现颈静脉怒张、肝大、水肿等右心衰竭的表现。急性肾衰竭（B错）会出现少尿等泌尿系统症状，高血压。心肌梗死后综合征（C错）表现为心包炎、胸膜炎或肺炎，有发热、胸痛等症状。低血糖反应（D错）的特点为乏力、头晕、出虚汗、面色苍白，有低血糖病史。